男，51岁。腹痛伴腹胀1天，暴饮暴食后突然剧烈上腹痛，之后出现腹胀，停止排气、排便。查体：T38.2℃，P120次/分，R25次/分，BP135/73mmHg。腹部明显膨隆，双侧腰肋部皮下瘀斑，全腹肌紧张，压痛和反跳痛（+），肠鸣音消失。实验室检查：血清淀粉酶180U/L，WBC17×10⁹/L。关于该患者的肠外营养支持，正确的是
A. 各种营养成分应单瓶输注
B. 以外周静脉输注为主
C. 在肠外营养时，可同时应用生长激素
D. 加入谷氨酰胺以保护肠黏膜屏障
E. 加入白蛋白作为肠外营养的氮源

正确答案：D。加入谷氨酰胺以保护肠黏膜屏障

解析：中年男性患者，暴饮暴食（急性胰腺炎常见诱因）后上腹剧痛，出现腹胀（急性胰腺炎的常见临床表现），停止排气排便（提示肠梗阻）。查体：腹部明显膨隆，双侧腰肋部皮下瘀斑（Grey-Turner征，提示急性出血坏死性胰腺炎可能）。全腹肌紧张，压痛和反跳痛（腹膜刺激征），肠鸣音消失（提示麻痹性肠梗阻）。实验室检查：血清淀粉酶180U/L，WBC17×10⁹/L。综合该患者的病史、体查及实验室检查，诊断考虑急性出血坏死性胰腺炎。禁食和胃肠减压可使包括促胃液素、促胰液素、缩胆囊素在内的胃肠激素分泌减少，从而减少胰液分泌，使胰腺得到休息，有利于胰腺修复，因此禁食和胃肠减压是急性胰腺炎的基本治疗。谷氨酰胺是小肠黏膜细胞的主要能源物质，可为合成代谢提供能量，因此在肠外营养液中加入谷氨酰胺，可以促进肠黏膜细胞增生，保护肠黏膜屏障（D对），减少肠源性感染。为使输入的物质在体内获得更好的代谢和利用，减少污染等并发症的机会，肠外营养时，应当将各种营养制剂混合后输注，而不是各种营养成分单瓶输注（A错）。重症胰腺炎患者禁食时间较长，可达1个月以上，行肠外营养时，一般宜选用中心静脉（颈内静脉、锁骨下静脉）输注，外周静脉输注适用于肠外营养不超过2周者（B错）。在肠外营养液中，不能加入抗生素、生长激素（C错）等其他药物，若需使用，需另外开放静脉通道。肠外营养液中，作为氮源的营养素是氨基酸，白蛋白价格昂贵，一般用于治疗低蛋白血症（E错）。